胎黄寒湿阻滞证的治法是
A. 清热利湿
B. 解表化湿
C. 温脾化湿
D. 运脾燥湿
E. 利水渗湿

正确答案：C。温脾化湿

解析：胎黄寒湿阻滞证是由于湿邪蕴于脾胃，脾阳受困，寒湿阻滞，气机不畅，以致肝失疏泄，胆液外溢所致，故治疗时应温中化湿退黄（C对）。